代表心房除极波形的是
A. P波
B. QRS波群
C. S-T段
D. T波
E. Q-T间期

正确答案：A。P波

解析：代表心房除极波形的是P波（A对）。QRS波群反应心室除极过程（B错）。S-T段反应心室的缓慢复极过程（C错）。T波反应了心室的快速复极过程（D错）。Q-T间期反应心室开始除极至心室复极完毕全过程的时间（E错）。